心房颤动患者服用华法林，凝血酶原时间的国际标准化率（INR）应控制在
A. 1.0～1.9
B. 2.0～3.0
C. 3.1～3.5
D. 3.6～4.0
E. ＞4.0

正确答案：B。2.0～3.0

解析：凝血酶原时间的国际标准化率（INR）是从凝血酶原时间（PT）和测定试剂的国际敏感指数（ISI）推算出来的。采用INR使不同实验室和不同试剂测定的PT具有可比性，便于统一用药标准。INR的值越高，血液凝固所需的时间越长。这样可以防止血栓形成，例如血栓导致的中风。但是，如果INR值非常高时，就会出现无法控制的出血的风险。心房颤动患者服用华法林时应使用INR有效监测其抗凝的效果，防止并发症的发生。通常凝血酶原时间的国际标准化率（INR）应控制在2.0～3.0（B对ACDE错）。